男，56岁，1个月颈肩痛，并向右手放射，右手拇指痛觉减弱，肱二头肌肌力弱。初步诊断是
A. 颈椎病
B. 肩周炎
C. 肩袖综合征
D. 臂丛神经炎
E. 颈部劳损

正确答案：A。颈椎病

解析：慢性脊髓压迫症早期病变较小，压迫尚未及脊髓时仅造成神经根的刺激，主要表现为神经根痛和受压神经的放射症状、患侧肢体远端的感觉减弱，可出现支配肌群的肌束震颤和肌无力。本例患者中老年男性，1个月颈肩痛（神经根痛），并向右手放射，右手拇指痛觉减弱，肱二头肌肌力弱，诊断为颈椎病（A对）。肩周炎（B错）、肩袖综合征（C错）、颈部劳损（E错）均为局部软组织及关节的病损，一般无神经症状。臂丛神经炎（D错）发病前后有发热，有肩部及上肢不同程度疼痛，持续性或阵发加剧。